行政法规的制定者是
A. 全国人民代表大会
B. 省、自治区、直辖市人民代表大会
C. 国务院
D. 国务院下属各部门
E. 省、自治区、直辖市人民政府

正确答案：C。国务院

解析：本题考查行政法规的制定者。行政法规的制定者是国务院（C对ABDE错）。